糖皮质激素特点中哪一项是错误的
A. 抗炎不抗菌，降低机体功能
B. 诱发和加重溃疡
C. 肝功能不良者须选用可的松或泼尼松
D. 使血液中淋巴细胞减少
E. 停药前应逐渐减量或采用隔日给药法

正确答案：C。肝功能不良者须选用可的松或泼尼松

解析：本题考查糖皮质激素的特点。可的松和泼尼松为前药，需在肝内分别转化为氢化可的松和泼尼松龙而生效，故严重肝功能不全者宜选择氢化可的松或泼尼松龙（C错，为本题正确答案）。糖皮质激素可诱发或加重感染，系本类药物降低机体防御功能的缘故（A对）。长期应用可诱发感染或使体内潜在病灶扩散，如真菌、结核病灶扩散恶化，特别是在原有疾病已使机体抵抗力降低时更易发生。在治疗严重感染性疾病时，必须给予有效、足量、敏感的抗菌药物。糖皮质激素能使胃蛋白酶和胃酸分泌增多，增加食欲，促进消化，但大剂量应用可诱发或加重胃及十二指肠溃疡（B对）。糖皮质激素使红细胞和血红蛋白含量增加，大剂量可使血小板增多并提高纤维蛋白原浓度，缩短凝血时间。此外，可使血液中嗜酸细胞及淋巴细胞减少（D对）。停用糖皮质激素时应
逐渐减量或采用隔日给药法，不宜骤停，以免复发或出现肾上腺皮质功能不足症状（E对）。